男，65岁，1小时前突发晕厥，意识恢复后自觉胸闷，气短，1周前行关节置换术治疗，否认高血压、心脏病史查体：BP90/65mmHg，双肺呼吸音清，未闻及干湿啰音。心率96次/分，P₂亢进，对明确诊断最有价值的检查是
A. 动脉血气分析
B. 头颅CT
C. 超声心动图
D. 血D－二聚体
E. CT肺动脉造影

正确答案：E。CT肺动脉造影

解析：老年男性患者，P₂亢进（肺动脉高压），有危险因素手术史，有呼吸困难、晕厥、肺动脉高压的表现，综合患者的症状、体征和辅助检查，初步诊断为肺血栓栓塞症，对明确诊断最有价值的检查是CT肺动脉造影（E对）。动脉血气分析（A错）主要用于诊断呼吸衰竭，肺血栓栓塞症常表现为低氧血症及低碳酸血症，可作为辅助诊断依据。头颅CT（B错）主要用于检查头颅疾病。超声心动图（C错）主要用于检查心功能，可发现右心室功能障碍，对肺血栓栓塞症的诊断有一定间接提示意义。血D－二聚体（D错）因特异性差，对肺血栓栓塞症无诊断价值。